碳链中只含一个不饱和双键的脂肪酸称为
A. 脂肪酸
B. 多不饱和脂肪酸
C. 单不饱和脂肪酸
D. 饱和脂肪酸
E. 反式脂肪酸

正确答案：C。单不饱和脂肪酸